非处方药的特点有
A. 按药品说明书购买使用
B. 必须凭医师处方购买使用
C. 安全性较高，疗效确切
D. 专业性强，仅能在医院药房购买
E. 使用、贮存方便

正确答案：A、B、C、E。按药品说明书购买使用；必须凭医师处方购买使用；安全性较高，疗效确切；使用、贮存方便